提出研究越轨与社会问题产生根源的“社会病理学”的科学家是
A. 魏尔啸
B. 迪尔凯姆
C. 诺尔曼
D. 盖林
E. 希波克拉底

正确答案：B。迪尔凯姆

解析：本题考查迪尔凯姆的地位。迪尔凯姆（B对ACDE错）是提出研究越轨与社会问题产生根源的“社会病理学”的社会学家。